目前，我国下列主要儿童常见疾病得到了有效控制，除了
A. 营养不良
B. 沙眼
C. 龋齿
D. 蛔虫感染
E. 贫血

正确答案：C。龋齿